高渗性脱水
A. 细胞外液容量增加
B. 细胞内液容量增加
C. 两者均有
D. 两者均无
E. 无

正确答案：D。两者均无

解析：高渗性脱水失水大于失钠，细胞外液容量减少（A错），由于细胞外液高渗，可使渗透压相对较低的细胞内液向细胞外转移，故细胞内液量也减少（B错，故D为本题正确答案）。